胰横卧于腹后壁，位置约平
A. 第12胸椎体
B. 第1-2腰椎体
C. 第3腰椎体
D. 第2-3腰椎体
E. 第4腰椎体

正确答案：B。第1-2腰椎体

解析：胰位于腹上区和左季肋区，横卧位置约平第1-2腰椎体(B对)。